社区人群牙周健康的重要判断标准是
A. 牙龈点彩消失
B. 牙龈颜色异常
C. 牙龈红肿
D. 牙龈出血
E. 牙周袋溢脓

正确答案：D。牙龈出血

解析：牙周病流行病学判断标准，WHO推荐使用CPI指数，判断牙龈出血、牙石积聚和牙周袋深度。掌握“牙周病流行病学及分级预防”知识点。